少阴温病，真阴欲竭，壮火复炽热，心中烦，不得卧者，治疗宜选
A. 小柴胡汤
B. 黄连阿胶汤
C. 龙胆泻肝丸
D. 黄芩汤加豆豉玄参方
E. 青蒿鳖甲汤

正确答案：B。黄连阿胶汤

解析：“少阴温病，真阴欲竭，壮火复炽热，心中烦，不得卧者”温病后期，肾阴亏于下，不能上济心火，心火亢于上，不能下温肾水，水火失济，形成心肾不交，阴虚火炽证。故临床可见心中烦，不得卧等症。方用黄连阿胶汤（B对）泻心火，滋肾水，交通心肾。